麦芽的功效是
A. 消食，疏肝
B. 消食，化痰
C. 消食，降气
D. 消食，理气
E. 消食，化湿

正确答案：A。消食，疏肝

解析：本题考查的是麦芽的功效。麦芽的功效是消食，疏肝（A对）。麦芽：【功效】消食和中，回乳，疏肝。莱菔子：【功效】消食除胀，降气（C错）化痰（B错）。化橘红：【功效】理气宽中，燥湿化痰，消食（D错）。功效为消食，化湿（E错）的中药，2022年考试指南未明确说明。